既补血，又活血的药是
A. 当归
B. 鹿茸
C. 墨旱莲
D. 沙苑子
E. 熟地黄

正确答案：A。当归

解析：本题考查的是当归的功效。既补血，又活血的药是当归（A对）。当归：【功效】补血活血，调经止痛，润肠通便。鹿茸（B错）：【功效】壮肾阳，益精血，强筋骨，调冲任，托疮毒。墨旱莲（C错）：【功效】滋阴益肾，凉血止血。沙苑子（D错）：【功效】补肾固精，养肝明目。熟地黄（E错）：【功效】补血滋阴，补精益髓。